患儿，女，3岁。生后发现口唇青紫，活动后加剧。平时喜蹲踞，哭吵时有突发呼吸急促、青紫加重，严重时伴晕厥，曾半年内晕厥2次，均于清晨或哭吵后发作，经2～3分钟自行恢复。今晨又出现晕厥，持续5分钟，即来急诊。查体：T37.0℃，P100次/分，R22次/分，BP82/55mmHg。神志不清，双肺听诊未见异常，胸骨左缘第2～4肋间闻及3/6级收缩期杂音，无震颤，肺动脉第二心音减弱。口唇青紫，指、趾甲青紫，杵状指、趾，颈软，神经系统查体无异常。该疾病最典型的心电图改变是
A. 右心房扩大
B. 预激综合征
C. 不完全性右束支传导阻滞
D. 右心室肥厚
E. 左心室肥厚

正确答案：D。右心室肥厚

解析：女性患儿，有青紫、杵状指、趾、蹲踞及阵发性缺氧发作的表现。神志不清，双肺听诊未见异常，胸骨左缘第2～4肋间闻及3/6级收缩期杂音（肺动脉狭窄表现），无震颤，肺动脉第二心音减弱。综合患者的症状、体征和辅助检查，最可能的诊断为法洛四联症。该疾病最典型的心电图改变是右心室肥厚（D对）。右心房扩大（A错）多见于肺动脉瓣狭窄严重者。预激综合征（B错）多见于青壮年男性。不完全性右束支传导阻滞（C错）临床上常无症状。左心室肥厚（E错）多无青紫、杵状指、趾、蹲踞及阵发性缺氧发作的表现。